针刺疗法治疗三叉神经痛时每次通电时间为
A. 5～15分钟
B. 10～20分钟
C. 15～25分钟
D. 15～30分钟
E. 20～30分钟

正确答案：D。15～30分钟

解析：针刺疗法：电流强度与频率应根据患者的耐受程度与即时效果进行交换与选择；开始宜弱，以后逐渐加强，每次通电15～30分钟，每日或隔日1次，10～12次为一疗程，每疗程间隔5～7天。掌握“三叉神经痛”知识点。